有关心静脉的描述，错误的是
A. 心大静脉与前室间支伴行
B. 心中静脉与后室间支伴行
C. 心小静脉与左旋支伴行
D. 心最小静脉直接开口于心腔
E. 冠状窦开口于右心房

正确答案：C。心小静脉与左旋支伴行

解析：心大静脉与前室间支伴行（A对）。心中静脉与后室间支伴行（B对）。心小静脉与右冠状动脉（C错，为本题正确答案）伴行。心最小静脉直接开口于心腔（D对）。冠状窦开口于右心房（E对）。